吐血色红或紫黯，口苦，胁痛，心烦易怒，寐少多梦，舌质红绛，脉弦数。治疗应首选
A. 加减泻白散合黛蛤散
B. 龙胆泻肝汤
C. 柴胡疏肝散
D. 丹栀逍遥散
E. 滋水清肝饮

正确答案：B。龙胆泻肝汤

解析：肝火横逆犯胃，胃络损伤，则吐血色红或紫黯；肝火上炎，则口苦胁痛，心烦易怒；热扰心神，故寐少梦多；舌质红绛，脉弦数为肝火亢盛，耗伤胃阴之象，治以泻肝清胃，凉血止血，代表方为龙胆泻肝汤（B对）。加减泻白散合黛蛤散，其功用为清肝泻肺、顺气降火，可用于内伤咳嗽之肝火犯肺证（A错）。柴胡疏肝散，其功用为疏肝理气，活血止痛，可用于郁证之肝气郁结证（C错）。丹栀逍遥散，其功用为疏肝解郁，清泻肝火，可用于郁证之气郁化火证（D错）。滋水清肝饮，其功用为滋阴清火，可用于郁证之气郁化火伤阴证（E错）。